某工人在夏季喷洒农药时，突感头痛、头晕，化验胆碱酯酶活性正常，可能是何种农药中毒
A. 有机磷农药
B. 氨基甲酸酯类农药
C. 拟除虫菊酯类农药
D. 对硫磷
E. 乐果

正确答案：C。拟除虫菊酯类农药

解析：本题考查各种农药中毒的症状。有机磷农药（A错）和氨基甲酸酯（B错）类农药的主要毒理作用是抑制胆碱酯酶的活性，对硫磷（D错）和乐果（E错）均属于有机磷酸酯类农药。本题中工人喷洒农药后，乙酰胆碱水平正常，判断为拟除虫菊酯类农药中毒（C对）。